长期应用可出现顽固性干咳的药物是
A. 氯沙坦
B. 硝苯地平
C. 肼屈嗪
D. 可乐定
E. 卡托普利

正确答案：E。卡托普利

解析：本题考查卡托普利。卡托普利（E对）属于血管紧张素转换酶抑制剂，可引起持续性干咳。氯沙坦（A错）长期服用会产生高血钾症。硝苯地平（B错）最常见副作用为头晕。肼屈嗪（C错）常见不良反应为头痛、恶心、呕吐、腹泻等。可乐定（D错）常见的不良反应是口干、嗜睡、头晕等。